动-静脉血氧含量差大于正常见于
A. 慢性阻塞性肺气肿
B. 低输出量性心力衰竭
C. 氰化物中毒
D. 亚硝酸盐中毒
E. 一氧化碳中毒

正确答案：B。低输出量性心力衰竭

解析：动-静脉血氧含量差大于正常见于循环性缺氧。慢性阻塞性肺气肿（A错）引起的缺氧属于乏氧性缺氧。低输出量性心力衰竭（B对）引起的缺氧属于循环性缺氧。氰化物中毒（C错）是引起组织性缺氧的原因。亚硝酸盐中毒（D错）和一氧化碳中毒（E错）是引起血液性缺氧的原因。